一般而言，（）和相继的磷酸三酯酶水解是有机磷酸酯类农药主要的代谢途径
A. 氧化
B. 还原
C. 加成
D. 氢化

正确答案：A。氧化

解析：本题考查有机磷酸酯类农药主要的代谢途径。一般而言，氧化（A对BCD错）和相继的磷酸三酯酶水解是有机磷酸酯类农药主要的代谢途径。